症见惊悸多梦，口燥咽干，头晕耳鸣，五心烦热，不易入睡，甚至彻夜不眠，兼心烦不寐者，属
A. 心肾不交
B. 肝肾阴虚
C. 肝阴虚
D. 心阳虚
E. 心阴虚

正确答案：A。心肾不交

解析：惊悸多梦，彻夜不眠，兼心烦不寐多提示病位在心。口燥咽干，头晕耳鸣，五心烦热，多提示有肾阴亏虚；心烦不寐，多由心火偏亢，扰动心神所致，故证属心肾不交证（A对）。肝肾阴虚证指肝肾两脏阴液亏虚，虚热内扰，以腰酸胁痛、两目干涩、眩晕、耳鸣、遗精及阴虚症状为主要表现的证（B错）。肝阴虚证指肝阴不足，虚热内生，以眩晕、目涩、胁痛及虚热症状为主要表现的证（C错）。心阳虚是指心阳虚衰，温运失司，虚寒内生，以心悸怔忡，或心胸疼痛及阳虚症状为主要表现的证（D错）。心阴虚指阴液亏损，心失滋养，虚热内扰，以心悸、心烦、失眠及阴虚症状为主要表现（E错）。